下列疾病，不会出现妇科血崩证的是
A. 堕胎
B. 崩漏
C. 经行吐衄
D. 晚期产后出血
E. 小产

正确答案：C。经行吐衄

解析：经行吐衄是每逢经行前后，或正值经期，出现周期性的吐血或衄血者，称“经行吐衄”，其病因由血热而冲气上逆，迫血妄行所致，其发作具有周期性，不会出现妇科血崩证（C对）。妇科血崩可由：崩漏（B错）、功能性子宫出血类月经病，或堕胎（A错）、小产（E错）、滋养细胞疾病、前置胎盘、显性出血性胎盘早剥等妊娠疾病，或产后血崩、晚期产后出血（D错）、或子宫肌瘤尤其是子宫黏膜下肌瘤、子宫颈癌、子宫内膜癌等多种中西医妇科疾病引起。